当患者在局麻时出现晕厥时，错误的处置是
A. 应立即停止注射麻药
B. 升高椅位使患者头抬高
C. 松解衣领
D. 芳香氨乙醇或氨水刺激呼吸
E. 吸氧并静脉注射高渗葡萄糖

正确答案：B。升高椅位使患者头抬高

解析：本题考查晕厥的防治措施。当患者在局麻时出现晕厥时，错误的处置是升高椅位使患者头抬高（B错，为本题的正确答案）。晕厥是一种突发性、暂时性意识丧失，是常见的局麻并发症之一，通常是由于一时性中枢缺血所致，一般可因恐惧、饥饿、疲劳及全身健康较差、疼痛以及体位不良等因素所引起；前驱症状有头晕、胸闷、面色苍白、全身冷汗、四肢厥冷无力、脉快而弱、恶心和呼吸困难；未经处理可出现心率减慢，血压急剧下降，短暂的意识丧失。防治原则是：一旦发生晕厥，应立即停止注射麻药（A对），迅速放平座椅，置患者于头低位，以使血液快速进入脑部，缓解中枢缺血症状；松解衣领（C对），保持呼吸通畅；芳香氨乙醇或氨水刺激呼吸（D对）；针刺人中穴，吸氧并静脉注射高渗葡萄糖（E对），以维持患者正常的血压等。